刮治器作洁治动作时的角度
A. 0°
B. 50°
C. 45°
D. 80°
E. 90°

正确答案：D。80°

解析：本题考查慢性牙周炎的治疗原则、程序及方法。刮治器作洁治动作时的角度为80°（D对）。 刮治时要改变刮治器的工作面与牙面的角度至45°～90°角之间，以70°～80°角为最佳，形成适当的“切割”位置，并以此角度进行刮治。